治疗肺痈溃脓期，应首选
A. 千金苇茎汤
B. 加味桔梗汤
C. 如金解毒散
D. 桔梗杏仁煎
E. 桔梗白散

正确答案：B。加味桔梗汤

解析：肺痈溃脓期的病机是热壅血瘀，血败肉腐，痈肿内溃，脓液外泄。治疗应该排脓解毒，首选加味桔梗汤（B对）。肺痈成痈期治宜清肺解毒，化瘀消痈，方选千金苇茎汤合如金解毒散（A错）。肺痈成痈期治宜清肺解毒，化瘀消痈，方选千金苇茎汤合如金解毒散（C错）。肺痈恢复期治宜清养补肺，方选桔梗杏仁煎（D错）。桔梗白散功能攻逐水饮，温下寒湿，用于治疗肺痈兼寒湿者（E错）。